长期饮用纯净水对健康造成不利影响的原因是
A. 使水质变软，消化功能减退
B. 去除了对人体有益的微量元素和无机矿物质
C. 在生产过程中增加了水中的有害元素
D. 纯净水不利于肝、肾病患者
E. 造成人体钙、磷缺乏

正确答案：B。去除了对人体有益的微量元素和无机矿物质

解析：本题考查长期饮用纯净水对健康造成不利影响的原因。从健康考虑，理想的饮用水应该保留天然化学特性，即含有适量的矿物质和微量元素。长期饮用纯净水对健康造成不利影响的原因是纯净水去除了对人体有益的微量元素和无机矿物质（B对ACDE错）。